对于健康促进学校，你认为理解错误的一项是
A. 健康促进学校要为学生提供完整、有益的经验和知识体系
B. 健康促进学校应开设正式的健康教育课
C. 健康促进学校要创造安全、健康的学校环境
D. 健康促进学校应提供适当的卫生服务
E. 健康促进学校要动员家庭和更广泛的社区参与

正确答案：B。健康促进学校应开设正式的健康教育课